使髋关节旋内
A. 长收肌
B. 耻骨肌
C. 臀大肌
D. 臀中肌
E. 梨状肌

正确答案：D。臀中肌

解析：长收肌（A错）和耻骨肌（B错）使髋关节内收和旋外。臀大肌（C错）使髋关节伸和旋外。臀中肌（D对）使髋关节外展、旋内和旋外。梨状肌（E错）使髋关节外展和旋外。